呼吸道感染患者服用复方新诺明出现荨麻疹，药师给患者的建议和采取措施正确的是
A. 告知患者此现象为复方新诺明的不良反应建议降低复方新诺明的剂量
B. 询问患者过敏史同服物及饮食情况建议患者停药并再次就诊
C. 建议患者使用氯雷他定片和皮炎平乳育治疗同时降低复方新诺明剂量
D. 建议患者停药如症状消失建议再次用药并综合评价不良反应
E. 得知患者当天食用海鲜认定为海鲜过敏建议不理会可继续用药

正确答案：B。询问患者过敏史同服物及饮食情况建议患者停药并再次就诊

解析：本题考查药品不良反应。呼吸道感染患者服用复方新诺明出现荨麻疹，药师给患者的建议和采取措施正确的是询问患者过敏史、同服物及饮食情况，建议患者停药并再次就诊（B对）。当在正常的用法用量下出现的这种情况，药品与患者所出现的不良反应之间的关联是很复杂的问题，实际很多的影响因素，首先应该了解患者及家族的药物和食物过敏史。